驱汞治疗的药物主要为
A. CaNa₂-EDTA
B. 亚硝酸钠
C. Na₂S₂O₃
D. 二巯基丙磺酸钠
E. CaNa₃-DTPA

正确答案：D。二巯基丙磺酸钠